某女，28岁。月经量少，色暗红，夹有小血块，小腹胀痛不适，经行后痛减，胸胁胀痛，腰骶疼痛；舌紫暗，有瘀点，脉沉弦。应采用的治法是
A. 运脾化痰，和血调经
B. 活血化瘀，养血调经
C. 补气养血，和血调经
D. 活血化瘀，固冲调经
E. 补肾益精，养血调经

正确答案：B。活血化瘀，养血调经

解析：本题考查月经过少之血瘀证的治法。结合患者症状为月经过少之血瘀证，应采用的治法是活血化瘀，养血调经（B对）。月经过少之血瘀证【症状】经血量少，色暗红，或夹有小血块；小腹胀痛不适，经行后痛减，或伴胸胁胀痛腰骶疼痛。舌紫暗，有瘀斑或瘀点，脉沉涩或沉弦。【治法】活血化瘀，养血调经。月经过少之痰湿证【症状】经血量少，色淡红，质黏稠或夹杂黏液；形体肥胖，胸脘满闷，倦怠乏力，或带下量多，色白质稀；舌胖，边有齿痕，苔白腻，脉弦滑或细滑。【治法】运脾化痰，和血调经（A错）。月经过少之气血亏虚证【症状】经血量少，经色淡红，质稀薄，伴面色萎黄，头晕眼花，心悸气短，经行小腹绵绵作痛。舌淡红，苔薄；脉细弱。【治法】补气养血，和血调经（C错）。月经先期之肾气虚证【症状】月经周期提前，经量或多或少，色淡暗，质清稀；腰膝酸软，头晕耳鸣，面色晦暗或面有暗斑。舌淡暗，苔白，脉沉细。【治法】补益肾气，固冲调经（D错）。月经过少之肾虚证【症状】经行量少，经色淡暗；伴面容憔悴，头晕耳鸣，腰骶酸软，小腹凉，夜尿多。舌淡暗，苔薄白，脉沉细。【治法】补肾益精，养血调经（E错）。